EB病毒感染后引起的病毒免疫逃逸机制是
A. 细胞内寄生
B. 抗原变异
C. 损伤免疫细胞
D. 降低抗原表达
E. 抗原结构复杂

正确答案：C。损伤免疫细胞